只能由公安机关实施，药品监督管理部门没有执行权的行政处罚是
A. 限制人身自由
B. 吊销许可证
C. 较少数额罚款
D. 没收违法所得

正确答案：A。限制人身自由

解析：本题考查的是行政处罚的种类。只能由公安机关实施，药品监督管理部门没有执行权的行政处罚是限制人身自由（A对）。行政处罚的种类：《中华人民共和国行政处罚法》第八条明确规定了行政处罚的种类，可归为以下四类。（1）人身罚：是指特定行政主体限制和剥夺违法行为人人身自由的行政处罚，如行政拘留。《行政处罚法》规定，“限制人身自由的行政处罚，只能由法律设定”。《药品管理法》规定，对生产销售假药和生产销售劣药情节严重的，以及伪造编造许可证件、骗取许可证件等情节恶劣的违法行为，可以由公安机关对相关责任人员处五日至十五日的拘留。（2）资格罚：是指行政主体限制、暂停或剥夺作出违法行为的行政相对人某种行为能力或资格的处罚措施。根据《行政处罚法》规定，资格罚主要包括责令停产停业、吊销许可证（B错）或者执照等。《药品管理法》规定的行政处罚中的资格罚包括：吊销药品批准证明文件、吊销药品生产许可证、吊销药品经营许可证、吊销医疗机构执业许可证、撤销检验资格、责令停产、停业，药物非临床安全性评价研究机构、药物临床试验机构一定期限内不得开展药物非临床安全性评价研究、药物临床试验，吊销执业证书等。另外，《药品管理法》规定生产、销售假药，或者生产、销售劣药且情节严重的法律责任，对违法企业的法定代表人、主要负责人、直接负责的主管人员和其他责任人员进行从业资格限制，终身禁止从事药品生产经营活动；对生产销售假药被吊销许可证的企业，十年内不受理其相应申请；规定伪造、变造、出租、出借、非法买卖许可证或者药品批准证明文件，提供虚假的证明、数据、资料、样品或者采取其他手段骗取临床试验许可、药品生产许可、药品经营许可、医疗机构制剂许可或者药品注册等许可，未遵守药品生产质量管理规范、药品经营质量管理规范、药物非临床研究质量管理规范、药物临床试验质量管理规范等且情节严重的法律责任，对违法企业的法定代表人、主要负责人、直接负责的主管人员和其他责任人员，十年直至终身禁止从事药品生产经营等活动。（3）财产罚：是指行政主体依法对违法行为人给予的剥夺财产权的处罚形式。财产罚是运用最广泛的一种行政处罚，其形式主要有罚款（C错）和没收财物（没收违法所得（D错）、没收非法财物等）两种。罚款，是行政主体依法强制违法行为人在一定期限内交纳一定数额货币的一种处罚方式，《药品管理法》中运用相当广泛。没收违法所得、没收非法财物，是行政主体依法将违法行为人的违法所得、违禁物品、违法行为工具等强制收归国有的一种处罚形式。以强制手段剥夺违法行为人的财产权，以此达到惩罚目的。药品行政处罚中的没收内容包括没收非法财物（药品、假药、劣药）、没收违法所得、没收与违法行为有关的其他财物等。（4）声誉罚：是指对违法者的名誉、荣誉、信誉或精神上的利益造成一定损害的处罚方式，是行政处罚中最轻的一种，具体形式主要有警告和通报批评两种。《行政处罚法》中设置的声誉罚只有警告，是指行政主体对实施了违法行为但情节较为轻微并造成实际危害后果的相对人的谴责和警戒。《药品管理法》第80条、第84条、第85条、第86条等都有“给予警告”的规定。